心脾有热，动风耗津的舌象表现是
A. 舌体歪斜
B. 舌体痿软
C. 舌体颤抖
D. 舌体板硬
E. 吐弄舌

正确答案：E。吐弄舌

解析：心开窍于舌，脾开窍于口，心脾有热，故舌常伸于口外，弄舌亦多见于热甚动风先兆（E对）。舌体歪斜多见中风或中风先兆（A错）。舌体痿软主气血俱虚，阴亏已极（B错）。舌体板硬主热入心包、热盛伤津、风痰阻络（D错）。舌体颤抖多主肝风内动（C错）。